女性，23岁。寒战，高热，咳脓痰2天。查体：体温39.2℃，左肺闻及湿啰音。X线胸片示：左下肺大片状致密影，给予抗生素治疗，2天后症状加重，胸痛并呼吸困难，左胸呼吸音降低。胸片示左胸腔积液。进一步诊断最有价值的方法是
A. 胸部CT
B. 结核素试验
C. 胸部超声波试验
D. 左侧胸膜腔穿刺
E. 痰细菌培养及药敏试验

正确答案：D。左侧胸膜腔穿刺

解析：胸腔积液疑为渗出液必须做胸腔穿刺，如有漏出液病因则避免胸腔穿刺，但是不能确定时也应该做胸腔穿刺检查，因为诊断性胸腔穿刺和胸水检查可明确积液性质和病因，是最有价值的诊断（D对）。虽然CT（A错）可显示肺内病变、胸内和胸膜转移性肿瘤等病变，有助于病因诊断，对恶性胸腔积液的病因诊断至关重要，但CT对肺炎、肺结核所致胸腔积液的病因诊断价值不大，故不是最有价值的诊断方法。结核菌素试验（B错）只能用于检出结核分枝杆菌的感染，而非检出结核病，仅对儿童、少年和青年的结核病诊断有参考意义，该试验不能明确胸腔积液的性质及病因。胸部超声波（C错）用于估计胸腔积液的深度和积液量，协助胸腔穿刺定位。痰细菌培养及药敏试验（E错）有助于肺炎的诊断、确定肺炎的病原菌及指导肺炎的用药，对明确胸腔积液性质及病因诊断价值不大。